可导致硬性下疳的病原体是
A. 溶脲脲原体
B. 梅毒螺旋体
C. 人乳头瘤病毒
D. 淋病奈瑟菌
E. 沙眼衣原体

正确答案：B。梅毒螺旋体

解析：本题考查可导致硬性下疳的病原体。可导致硬性下疳的病原体是梅毒螺旋体（B对）。溶脲脲原体（A错）为条件致病菌，主要通过性接触传播，引起非淋菌性尿道炎、尿路结石等。人乳头瘤病毒（HPV）（C错）主要引起人类皮肤黏膜的增生性病变，其中高危型HPV（16型、18型等）与子宫颈癌等恶性肿瘤的发生密切相关，低危型HPV（6型、11型等）引起生殖器尖锐湿疣。淋病奈瑟菌（D错）是引起人类泌尿生殖系统黏膜化脓性感染（淋病）的病原菌。沙眼衣原体（E错）主要寄生于人类，主要引起沙眼、包涵体结膜炎、泌尿生殖道感染、婴幼儿肺炎、性病淋巴肉芽肿等疾病。